产后三审是指
A. 腹痛、便秘、出血
B. 腹痛、便秘、乳汁
C. 腹痛，便秘，饮食
D. 冲肾，冲心，冲肺
E. 冲胃，冲心，冲肺

正确答案：B。腹痛、便秘、乳汁

解析：产后三审是指产后病的辨证应该注重三点，即：1.审小腹痛与不痛，以辨恶露有无停滞；2.审大便通与不通，以验津液之盛衰；3.审乳汁的行与不行以及饮食之多少，以察胃气的强弱（B对）。产后三冲是冲胃，冲心，冲肺（E错）。